纤维蛋白被纤溶酶水解后生成：
A. PAF
B. 纤维蛋白单体
C. PF
D. FDP
E. MDF

正确答案：D。FDP

解析：FDP（D对）即纤维蛋白（原）降解产物是纤溶酶水解纤维蛋白（原）产生的各种片段。在凝血过程中，凝血酶使纤维蛋白原转变为纤维蛋白单体（B错），最终形成交联的纤维蛋白多聚体。PAF（A错）是血小板活化因子。MDF（E错）是心肌抑制因子。